医务人员彼此协作的基础是
A. 没有分歧
B. 彼此独立
C. 互相信任
D. 互相学习
E. 彼此竞争

正确答案：C。互相信任

解析：互尊互学、团结协作是正确处理同事、同行之间医际关系的医德准则（P61），而医务人员彼此协作的基础和前提是互相信任（C对）。